下列属于三叉神经功能检查的是
A. 感觉功能
B. 角膜反射
C. 腭反射
D. 运动功能
E. 以上均是

正确答案：E。以上均是

解析：三叉神经功能检查：①感觉功能；②角膜反射；③腭反射；④运动功能。掌握“三叉神经痛”知识点。